儿童膳食中碳水化合物提供的能量占总能量的适宜比例为
A. 12%～15%
B. 45%～50%
C. 50%～65%
D. 25%～30%
E. 60%～70%

正确答案：C。50%～65%

解析：本题考查营养素与参考摄入量。2岁以上儿童膳食中，碳水化合物所产的能量应占总能量的50%～65%（C对ABDE错）。保证充分碳水化合物的摄入，提供合适比例的能量来源是重要的，如碳水化合物产能＞80%或＜40%都不利于健康。